急性高镁血症的紧急治疗措施是
A. 改善肾功能
B. 静注钙制剂
C. 治疗原发病
D. 纠正酸中毒
E. 静脉输注生理盐水

正确答案：B。静注钙制剂

解析：高浓度的镁能抑制房室和心室内传导，并降低心肌兴奋性，严重时可发生心搏骤停，钙和镁在肾小管中被重吸收时有相互竞争作用，静注钙制剂（B对）使肾小管重吸收镁减少以减轻镁对心肌的抑制作用。治疗原发病（C错）、改善肾功能（A错）、纠正酸中毒（D错）、静脉输注生理盐水（E错）都可降低血镁浓度，改善高镁血症，但不作为急性高镁血症的紧急治疗措施（ACDE错）。